男，35岁。因5天来右下后牙肿痛，今日全身不适来就诊。查患者痛苦面容，右面颊部肿胀较明显。右下第一前磨牙远中颈部龋深穿髓，无探痛，Ⅲ度松动，叩痛（+++），龈红肿明显，移行沟变平。还应为患者做的检查如下，除外
A. 测体温
B. 牙髓温度测验
C. 查白细胞计数
D. X线片检查
E. 扪诊颌下淋巴结

正确答案：D。X线片检查

解析：本题考查急性根尖周炎的检查。该患者病程只有5天，不会形成慢性疾病，故其X线检查无明显异常表现（D错，为本题的正确答案）。因为患者表现痛苦面容，患牙Ⅲ度松动，叩痛（+++），龈红肿明显，移行沟变平，怀疑急性根尖周炎，体温可能升高，故应测体温的检查确诊（A对）。患者口腔检查发现第一前磨牙远中颈部龋深穿髓，所以需要牙髓温度测验（B对）来检测牙髓活性。急性根尖周炎末梢血象白细胞增多，故应查白细胞计数（C对）。如为急性牙槽脓肿，化脓性感染病灶常会引起所属区域淋巴结肿大和扪痛的症状，故应扪诊颌下淋巴结（E对）。